下列各项，属于被动体位的是
A. 角弓反张
B. 辗转体位
C. 肢体瘫痪
D. 端坐呼吸
E. 以上均非

正确答案：C。肢体瘫痪

解析：体位指患者身体所处的状态，可分为自主体位、被动体位及强迫体位。自主体位指身体活动自如，不受限制，见于正常人、轻症和疾病早期。被动体位指患者不能自己调整或变换身体的位置，见于极度衰弱、肢体瘫痪（C对）或意识障碍者。强迫体位指患者为减轻痛苦，被迫采取某种特殊的体位，包括强迫仰卧位、强迫俯卧位、强迫侧卧位、端坐呼吸（D错）、强迫蹲位、强迫停立位、辗转体位（B错）、角弓反张位（A错）。